B细胞的BCR结合的抗原为
A. TD抗原
B. TI抗原
C. 颗粒性抗原
D. 可溶性抗原
E. 外源性抗原和内源性抗原

正确答案：D。可溶性抗原

解析：B细胞也是专职的APC。活化的B细胞可借其BCR结合可溶性抗原，将其内化、加工、处理，以抗原肽-MHC分子复合物的形式提呈给T细胞。掌握“白细胞分化抗原及黏附分子”知识点。